对于拟杆菌属等厌氧菌有抗菌活性的头霉素类药物是
A. 头孢唑林
B. 阿莫西林
C. 头孢呋辛
D. 头孢美唑
E. 头孢曲松

正确答案：D。头孢美唑

解析：本题考查头霉素类抗菌药物。头霉素类药物包括：头孢美唑（D对）、头孢西丁、头孢米诺。